对精神分裂症最具有诊断价值的症状是
A. 心因性幻听
B. 命令性幻听
C. 反射性幻听
D. 假性幻听
E. 功能性幻听

正确答案：B。命令性幻听

解析：精神分裂症的阳性症状可表现为幻觉，其中以听幻觉最常见，在意识清晰状态下出现评论性幻听、争论性幻听或命令性幻听，是精神分裂症的典型症状（B对）。心因性幻觉多见于应激相关障碍、分离（转换）障碍（A错）。